借助载体帮助，不消耗能量，从膜的高浓度侧向低浓度一侧转运药物的方式是
A. 膜动转运
B. 简单扩散
C. 主动转运
D. 滤过
E. 易化扩散

正确答案：E。易化扩散

解析：本题考查药物的转运方式。借助载体帮助，不消耗能量，从膜的高浓度侧向低浓度一侧转运药物的方式是易化扩散（E对）；膜动转运（A错）是细胞膜通过主动变形将某些物质摄入细胞内或从细胞内释放到细胞外的过程；简单扩散（B错）无需载体；主动转运（C错）是逆浓度梯度的运输方式；滤过（D错）是指水溶性小分子物质依靠膜两侧的流体静压或渗透压通过孔道的过程。